引起血清肌酸激酶（CK）增高的疾病是
A. 早期急性心肌梗死
B. 甲状腺功能亢进
C. 急性颅脑损伤
D. 成人脑膜炎
E. 癫痫大发作

正确答案：A。早期急性心肌梗死

解析：本题考查的是血清肌酸激酶（CK）增高的临床意义。引起血清肌酸激酶（CK）增高的疾病是早期急性心肌梗死（A对）。肌酸激酶（CK）主要存在于胞质和线粒体中，以骨骼肌和心肌最多，其次是脑组织和平滑肌，肝脏、胰腺和红细胞中有极少含量。血清CK活性增高有临床意义。肌酸激酶同工酶：CK是由B和M两个亚单位组成的二聚体，形成3个不同的亚型：①CK-MM，主要存在于骨骼肌以及其他肌肉中；②CK-MB，主要存在于心肌中；③CK-BB，主要存在于脑、前列腺、肺、肝、肠等组织中。正常血清中绝大部分为CK-MM的活力，CK-MB活力不超过总活力的5%，CK-BB则微乎其微。血清CK同工酶升高有临床意义。临床意义：1.血清CK增高：（1）心脏疾病：①CK为早期诊断急性心肌梗死（AMI）的灵敏指标之一。②其他心脏损伤：见于病毒性心肌炎、心脏手术或创伤性心脏介入治疗等。（2）肌肉疾病：如进行性肌萎缩、皮肌炎、急性脊髓灰质炎等。（3）药物性肌损：如服用他汀类药物，或他汀类与贝丁酸类药物联用引起的肌病。（4）其他：如急性脑血管疾病、甲状腺功能减退症（B错），非疾病因素（如剧烈运动）。2.血清CK同工酶增高：（1）CK-MB增高：①诊断AMI：CK-MB是早期诊断AMI的重要指标之一。②其他心肌损伤：如不稳定性心绞痛、心肌炎等。（2）CK-MM增高：血清CK-MM是骨骼肌损伤的特异指标，如手术、创伤、癫痫大发作（E错）后48小时内CK-MM活性增高，以及他汀类药物引起的肌损。（3）CK-BB增高：①神经系统疾病，如脑血管意外、急性颅脑损伤（C错）、脑膜炎（D错）等。②恶性肿瘤，如肺、肠、胆囊、前列腺等部位的肿瘤。